关于三度房室传导阻滞的表述，不正确的是
A. 阻滞部位均位于希氏束以下的束支系统
B. 是由于房室传导系统某一部分有效不应期极度延长，大于逸搏间期
C. 心电图表现为PR间期不固定，心房率快于心室率
D. 如果逸搏心律的QRS波群增宽，阻滞部位大多发生在希氏束以下的部位
E. 少数情况下可同时存在两个逸搏起搏点，引起逸搏心律不匀齐

正确答案：A。阻滞部位均位于希氏束以下的束支系统

解析：关于房室传导阻滞，目前心电学的定义的部位是指房室结、希氏束及束支的阻滞，可以是单一部位的阻滞，也可以是多部位的阻滞，实质是不应期的异常延长，使激动自心房传布的过程中出现传导延缓或激动不能下传至心室的现象。三度房室传导阻滞是指所有来自心房的冲动都不能到心室，阻滞部位可位于房室结、希氏束和双侧束支水平，心室的激动由房室结以下的被动心律产生，即逸搏心律（A错）。如出现室性逸搏心律，往往提示发生阻滞的部位较低。由于心房与心室分别由两个不同的起搏点激动，各自保持自身的节律，心电图上表现为：P波与QRS波群毫无关系（PR间期不固定），心房率快于心室率。